上述病原体中，血浆凝固酶（+）的是
A. 肺炎克雷伯杆菌
B. 大肠埃希菌
C. 铜绿假单胞菌
D. 金黄色葡萄球菌
E. 流感嗜血杆菌

正确答案：D。金黄色葡萄球菌

解析：金黄色葡萄球菌（D对）能产生凝固酶，实验室血浆凝固酶试验（+）；凝固酶与葡萄球菌的致病力密切相关，可使周围血液或血浆中的纤维蛋白等沉积于细菌表面，阻碍吞噬细胞的吞噬或胞内消化作用，还能保护病菌不受血清中杀菌物质的破坏，因此葡萄球菌繁殖引起的周围纤维蛋白沉积和凝固使感染易于局限化和形成血栓。肺炎克雷伯杆菌（A错）、大肠埃希菌（B错）、铜绿假单胞菌（C错）和流感嗜血杆菌（E错）均不产生凝固酶。